胶丸的制备可选用
A. 滴制法
B. 热熔法
C. 乳化法
D. 塑制法
E. 压灌法

正确答案：A。滴制法

解析：本题考查的是软胶囊的制备方法。胶丸的制备可选用滴制法（A对）。软胶囊：系指将一定量的液体原料药物直接包封，或将固体原料药物溶解或分散在适宜的辅料中制备成溶液、混悬液、乳状液或半固体，密封于软质囊材中的胶囊剂。软胶囊又称胶丸，可用滴制法或压制法制备。热熔法（B错）为双黄连栓剂的制备方法。乳化法（C错）为乳剂的制备方法。乳剂系指两种互不相溶的液体，经乳化制成的一种液体以液滴状态分散于另一相液体中形成的非均相分散体系的液体制剂。塑制法（D错）为塑制丸的制法。塑制丸：系指药物细粉与适宜黏合剂混合制成的可塑性丸块，经制丸机或丸模制成的丸剂，如蜜丸及部分糊丸、浓缩丸等。压灌法（E错）为将气雾剂的抛射剂装入容器的方法。